细颗粒物也被称为
A. TSP
B. 可吸入颗粒物
C. 呼吸性粉尘
D. PM₂.₅
E. PM₁₀

正确答案：D。PM₂.₅

解析：本题考查细颗粒物。细颗粒物也被称为PM₂.₅（D对ABCE错），是指空气动力学直径≤2.5μm的细颗粒。